下列关于年轻恒牙髓腔解剖的叙述中，不恰当的一项是
A. 髓腔大
B. 根尖孔大
C. 牙髓组织丰富
D. 牙髓的恢复能力强
E. 血供不充足

正确答案：E。血供不充足

解析：青年人的髓腔大，牙髓组织丰富，细胞成分多，根尖孔大，血供非常充足，牙髓的恢复能力强，治疗易于成功。掌握“髓腔各部分名称、增龄性变化及临床意义”知识点。